患者，女，46岁，因琐事吵架后服用艾司唑仑100片，可选用的解救药物是
A. 亚甲蓝
B. 氟马西尼
C. 纳洛酮
D. 二巯丙醇
E. 乙酰胺

正确答案：B。氟马西尼

解析：本题考查苯二氮䓬类药物的中毒解救。氟马西尼（B对）可用于苯二氮䓬类药物过量或中毒解救。艾司唑仑属于苯二氮䓬类镇静催眠药，氟马西尼是特异的苯二氮䓬受体拮抗剂，能快速逆转昏迷。亚甲蓝（A错）用于氰化物中毒，小剂量可治疗高铁血红蛋白血症（亚硝酸盐中毒等）。纳洛酮（C错）用于急性阿片类中毒（表现为中枢和呼吸抑制）及急性酒精中毒。二巯丙醇（D错）用于砷、汞、金、铋及酒石酸锑钾中毒。乙酰胺（E错）用于有机氟杀虫农药中毒。